男，45岁。血AFP明显升高1个月。有慢性乙型肝炎病史10年。腹部B超发现肝内有3个实性结节，最大径分别为0.5cm、0.7cm和1.2cm，周围肝组织是明显的肝硬化改变，术后病理为原发性肝细胞性肝癌，其分型属于
A. 大肝癌
B. 弥漫型肝癌
C. 结节型肝癌
D. 小肝癌
E. 巨块型肝癌

正确答案：C。结节型肝癌

解析：肝癌大体病理分为三型， 即块状型 、 结节型、弥漫型 。 小肝癌 、 大肝癌均属于临床分型，而不是病理分型，故不答 AD。 结节型肝癌（C对）呈大小、数目不等的癌结节，直径 ＜5cm， 常伴肝硬化 。小肝癌是指癌肿直径 ＜3cm， 大肝癌是指癌肿直径 ＞5cm 。 巨块型肝癌（E错）是指癌肿直径 ＞10cm 。 弥漫型肝癌（B错）是指米粒至黄豆大小的癌结节，弥漫分布于整个肝脏 。